男性，51岁。急性前壁心肌梗死，起病第二天发生心房颤动，心室率184次/分，血压84/60mmHg，气急发绀，首选的治疗措施
A. 静脉注射毛花苷丙
B. 同步电去除颤
C. 静脉注射美托洛尔
D. 静脉注射多巴酚丁胺
E. 静注胺碘酮

正确答案：B。同步电去除颤

解析：患者中年男性，急性前壁心肌梗死并伴心房颤动，气急发绀（急性心力衰竭导致的肺水肿引起），血压84/60mmHg（正常值90～139/60～89mmHg，偏低），心室率184次/分（正常值60～100次/分，偏快），此时患者首选的治疗措施应为同步电除颤（同步电复律）（B对）。电复律（P208）的机制是将一定强度的电流通过心脏，使全部或大部分心肌在瞬间除极。然后心脏自律性最高的起搏点重新主导心脏节律，通常是窦房结。同步电复律是指放电时电流正好与R波同步，即电流刺激落在心室肌的绝对不应期。静脉注射毛花甘丙（A错）多用于急性心力衰竭的强心治疗，通过增加心肌收缩力，增加心排出量，减轻急性肺水肿，但对心室率过快导致的血流动力学紊乱无效。静脉注射美托洛尔（C错）可降低血压，本例患者血压偏低（收缩压＜90mmHg），且有急性心力衰竭的症状，因此慎用。多巴酚丁胺（P176）（D错）为β受体激动剂，能增加心肌收缩力和升高血压，可用于急性心力衰竭的治疗，但多巴酚丁胺在治疗房颤时能加快房室传导，加快心室率，如须用本品，应先给予洋地黄类药。在房颤的治疗中，合并器质性心脏病患者可选用胺碘酮（E错）转复和维持窦性心律，但若已出现急性心衰或血压下降应尽快实施电复律。